冠心病、恶性肿瘤、中风的主要危险因素为
A. 战争
B. 营养不良
C. 免疫接种覆盖率下降
D. 不良行为和不科学的生活方式
E. 其他因素

正确答案：D。不良行为和不科学的生活方式